无龋患儿为
A. 出生4个月的婴儿
B. 出生6个月的婴儿
C. 出生8个月的婴儿
D. 出生10个月的婴儿
E. 出生12个月的婴儿

正确答案：A。出生4个月的婴儿

解析：本题考查无龋患儿。无龋患儿即没有龋病的小儿，出生4个月的婴儿（A对）第一颗乳牙尚未萌出，口内无牙，待婴儿出生后4～6个月第一颗乳牙才开始萌出。根据四联因素学说，宿主因素是致龋的因素之一，无牙则无龋，所以出生4个月的婴儿不会患龋。6个月以上的婴儿（BCDE错），乳牙陆续萌出，在口腔卫生不佳的情况下有可能患龋。